周，同时伴有急躁易怒，胸胁胀痛，口苦咽干，舌红苔黄，脉弦数。其证候是
A. 阴虚火旺
B. 肝郁脾虚
C. 肝郁火旺
D. 脾虚失摄
E. 气阴两虚

正确答案：C。肝郁火旺

解析：乳衄是以乳窍溢出血性液体，乳头或乳晕部触及可活动的质软、不痛肿块为主要表现的肿瘤性疾病。患者急躁易怒，胸胁胀痛，为肝气郁结之表现，口苦咽干，舌红苔黄，脉弦数为肝郁化火之征象（C对）。阴虚火旺可有心烦失眠、口燥咽干、盗汗、两颧潮红等，本患者没有（A错）。肝郁脾虚可伴见食少纳呆，脘腹胀闷，四肢倦怠等，本患者未具（B错）。脾虚失摄为本病另一个证型，伴多思善虑，面色少华，神疲倦怠，心悸少寐，纳少，舌质淡，苔薄白，脉细（D错）。气阴两虚可见口渴、神疲气短等，本患者未有（E错）。